适用于心功能比较稳定的Ⅱ～Ⅲ级心力衰竭患者的药物是
A. 氢氯噻嗪
B. 米力农
C. 氯沙坦
D. 卡维地洛
E. 多巴酚丁胺

正确答案：D。卡维地洛

解析：本题考查卡维地洛。适用于心功能比较稳定的Ⅱ～Ⅲ级心力衰竭患者的药物是卡维地洛（D对）。卡维地洛适应证：1.原发性高血压。可单独用药，也可和其他降压药合用，尤其是噻嗪类利尿剂。2.心功能不全。轻度或中度心功能不全NYHA分级Ⅱ或Ⅲ级，合并应用洋地黄类药物、利尿剂和血管紧张素转换酶抑制剂ACEI。也可用于ACEI不耐受和使用或不使用洋地黄类药物、肼屈嗪或硝酸酯类药物治疗的心功能不全者。氢氯噻嗪（A错）为噻嗪类利尿药。米力农（B错）为磷酸二脂酶Ⅲ（PDE-Ⅲ）抑制药，适用于对洋地黄、利尿剂、血管扩张剂治疗无效或效果欠佳的各种原因引起的急、慢性顽固性充血性心力衰竭。氯沙坦（C错）为血管紧张素Ⅱ受体阻断剂类降压药。多巴酚丁胺（E错）为非强心苷类正性肌力，临床用于心肌梗塞后或心脏外科手术时心排出量低的休克患者，疗效优于异丙肾上腺素，且较安全。用于心排出量低和心率慢的心力衰竭患者，其改善左心室功能的作用优于多巴胺。